男，25岁。右手腕部被机器绞伤，皮肤脱套，异常活动，创口流血。正确的处理方法是
A. 简单包扎，消炎治疗
B. 直接缝合，包扎伤口
C. 清创后有骨折和脱位者，必须复位固定
D. 对重要血管损伤留待二期处理
E. 肌腱损伤修补后立即进行功能锻炼，防止粘连

正确答案：C。清创后有骨折和脱位者，必须复位固定

解析：手部解剖结构复杂、活动灵活、功能要求高。患者手腕部绞伤，创口出血，应早期彻底清创止血，不可进行简单包扎，消炎治疗（A错）。患者有皮肤撕脱伤，不可直接缝合，否则易致皮下积血，影响皮瓣成活（B错）。患者手腕部有异常活动，应考虑手腕部骨折，手部的骨折关节脱位应及时复位固定（C对）。手部血液循环丰富，重要血管损伤（D错）应一期处理，以免影响手部功能的恢复。肌腱缝合后需固定3～4周，待组织愈合后，拆除固定再进行功能锻炼（E错）。